下列哪一种物质不能引起血管扩张？
A. 腺苷
B. 心肌抑制因子
C. 缓激肽
D. 组胺
E. 内啡肽(endorphin)

正确答案：B。心肌抑制因子

解析：局部血管活性物质如组胺（D对）、缓激肽（C对）、腺苷（A对）、PGI₂、内啡肽（E对）等则引起血管舒张；乳酸等酸性产物的堆积则可降低血管平滑肌对缩血管物质的反应性，而导致血管扩张。心肌抑制因子（B错，为本题正确答案）不能引起血管扩张。